冬虫夏草的主产地之一是
A. 陕西
B. 山西
C. 安徽
D. 四川
E. 贵州

正确答案：D。四川

解析：本题考查的是冬虫夏草的产地。冬虫夏草的主产地之一是四川（D对）。冬虫夏草：【产地】主产于四川、西藏、青海等省区，甘肃、云南、贵州等省亦产。主产于陕西（A错）的药材有藁本、茜草、淫羊藿、沙苑子、南五味子、猪苓等。主产于山西（B错）的药材有苦参、远志、党参、香加皮、蒲公英、连翘、硫黄等。主产于安徽（C错）的药材有南沙参、桑白皮、牡丹皮、菊花、木瓜、决明子、大蓟、茯苓等。主产于贵州（E错）的药材为贵药。贵药：主产地贵州。如天冬、天麻、黄精、杜仲、吴茱萸、五倍子、朱砂等。